女，24岁。人工流产术出现血压下降，心率减慢，面色苍白，处理方法应是
A. 输液
B. 肌注催产素
C. 立即剖腹探查
D. 静注阿托品
E. 不应停止操作

正确答案：D。静注阿托品

解析：患者为青年女性，人流术中出现血压下降、心率减慢、面色苍白（人工流产综合反应指手术时疼痛或局部刺激，使受术者在术中或术毕出现恶心呕吐、心动过缓、心律不齐、面色苍白、头昏、胸闷、大汗淋漓），应考虑诊断为人工流产综合反应。处理方法是：发现症状应立即停止操作（E错），治疗首选阿托品静脉注射（D对），抑制迷走神经兴奋。输液为一般性治疗（A错）。催产素（P383）（B错）用于人工流产术中出血的患者，使子宫收缩止血。剖腹探查（P384）（C错）用于子宫穿孔大、有内出血或怀疑脏器损伤的患者。